我国2009年制定《全国自然灾害卫生应急预案》（试行），按灾害的性质将自然灾害分为七大类，是指
A. 气象、海洋、水旱、泥石流、地震、生物和森林草原火灾七大类
B. 冻雨、海啸、土地荒漠化、地质、地震、生物和森林草原火灾七大类
C. 气象、海洋、水旱、地质、地震、生物和森林草原火灾七大类
D. 龙卷风、海啸、水旱、地质、地震、沙尘暴和森林草原火灾七大类
E. 气象、海洋、洪水、干旱、地质、地震和森林草原火灾七大类

正确答案：C。气象、海洋、水旱、地质、地震、生物和森林草原火灾七大类

解析：本题考查自然灾害按灾害的性质的分类。自然灾害是指以自然变异为主要因素造成的，危害人类生命健康、财产、社会功能以及资源、环境，且超出受影响者利用自身资源进行应对和处置能力的事件或现象。根据国家原卫生部发布的《全国自然灾害卫生应急预案》（试行），按灾害的性质将自然灾害分为气象、海洋、水旱、地质、地震、生物和森林草原火灾七大类（C对ABDE错）。